脑梗死病位在脑，涉及的脏腑是
A. 肝、肺、肾、心
B. 心、肝、肾、脾
C. 肺、脾、肾、心
D. 心、肺、肾、胃
E. 肝、脾、肺、心

正确答案：B。心、肝、肾、脾

解析：脑梗死基本病机是阴阳失调，气血逆乱，上犯于脑。以正虚为发病之本，以肝肾阴虚，气血不足为主；邪实为致病之标，以风、火、痰浊、瘀血为主。病位在脑，与心、肝、肾、脾密切相关（B对）。